能使肿瘤发生出血性坏死的细胞因子是
A. 补体
B. 乙型溶素
C. TNF
D. IgG
E. 溶菌酶

正确答案：C。TNF

解析：肿瘤坏死因子（TNF）是能使肿瘤发生出血性坏死的细胞因子。掌握“细胞因子及受体”知识点。